女，46岁。今晨咯血100mL，无发热。幼时起反复咳嗽，咳痰。查体：T36.8℃，BP120/70mmHg，左肺可闻及湿啰音。该患者最可能的诊断是
A. 肺结核
B. 支气管扩张
C. 支气管肺癌
D. 慢性支气管炎
E. 肺炎链球菌肺炎

正确答案：B。支气管扩张

解析：患者幼时即有症状，持续咳嗽、咳痰，近日出现咯血（为支气管扩张的典型表现），无明显发热，根据患者病史及临床表现，考虑诊断为支气管扩张症（B对）（符合咳嗽、咳痰、咯血的典型症状并从幼年持续至成年的特征）。肺结核（P65）（A错）也可出现咳嗽、咳痰以及咯血症状，但一般会出现发热症状，并且较少从幼年持续至成年。支气管肺癌（P77）（C错）早期症状常为刺激性干咳，可出现痰血或咯血，常出现消瘦，与患者症状不符。慢性支气管炎（P20）（D错）一般出现长期咳嗽、咳痰，但基本不出现咯血症状。肺炎链球菌性肺炎（P46）（E错）常出现高热、寒战症状，本患者无发热。